口腔叙述错误的是
A. 消化管的起始部
B. 分为口腔前庭和固有口腔
C. 上壁为腭
D. 外侧壁是唇
E. 借咽峡与咽腔相通

正确答案：D。外侧壁是唇

解析：口腔为消化管的起始部(A对)，分为前外侧口腔前庭和后内侧固有口腔(B对)，上壁为腭(C对)，外侧为颊(D错，为本题正确答案)，口腔向后经咽峡与咽腔相通(E对)。